影响粉尘生物学作用的最主要因素
A. 粉尘的化学组成及浓度
B. 浓度及分散度
C. 化学组成及分散度
D. 浓度及荷电性

正确答案：A。粉尘的化学组成及浓度

解析：本题考查粉尘的生物学作用。工作场所空气中粉尘的化学成分和浓度（A对BCD错）直接决定其对人体危害性质和严重程度。不同化学成分的粉尘可导致纤维化、刺激、中毒和致敏作用等。同一种粉尘，作业环境空气中浓度越高，暴露时间越长，对人体危害越严重。